分子中含有吗啉基团，以S-左旋体上市的β-受体拮抗剂是
A. 盐酸普萘洛尔
B. 盐酸索他洛尔
C. 酒石酸美托洛尔
D. 艾司洛尔
E. 马来酸噻吗洛尔

正确答案：E。马来酸噻吗洛尔

解析：本题考查β-受体拮抗剂的作用特点。马来酸噻吗洛尔（E对）是为数不多的以活性异构体S-异构体作为药用的β-受体拮抗剂，是已知作用最强的非选择性β受体阻滞剂，结构中含有吗啉基团。